执业药师或药师对处方用药进行适宜性审核的内容不包括
A. 处方用药与临床诊断的相符性
B. 剂量、用法的正确性
C. 选用剂型与给药途径的合理性
D. 药品金额的准确性
E. 是否有重复给药现象

正确答案：D。药品金额的准确性

解析：本题考查的是处方审核的内容。执业药师或药师对处方用药进行适宜性审核的内容不包括药品金额的准确性（D错，为本题正确答案）。处方的适宜性审核内容包括 ：①西药及中成药处方，应当审核以下项目：处方用药与诊断是否相符（A对）；规定必须做皮试的药品，是否注明过敏试验及结果的判定；处方剂量、用法是否正确（B对），单次处方总量是否符合规定；选用剂型与给药途径是否适宜（C对）；是否有重复给药和相互作用情况，包括西药、中成药、中成药与西药、中成药与中药饮片之间是否存在重复给药（E对）和有临床意义的相互作用；是否存在配伍禁忌；是否有用药禁忌：儿童、老年人、孕妇及哺乳期妇女、脏器功能不全患者用药是否有禁忌使用的药物，患者用药是否有食物及药物过敏史禁忌证、诊断禁忌证、疾病史禁忌证与性别禁忌证；溶媒的选择、用法用量是否适宜，静脉输注的药品给药速度是否适宜；是否存在其他用药不适宜情况。